小儿断奶时间应在
A. 2〜3个月
B. 4〜5个月
C. 6〜7个月
D. 8〜12个月
E. 13〜18个月

正确答案：D。8〜12个月

解析：断奶时间视母婴情况而定。一般可在小儿10~12个月时断奶。D选项最接近（D对）。2-3个月按照小儿睡眠规律可每2-3小时喂1次，逐渐延长到3-4小时1次，夜间逐渐停1次，一昼夜共6-7次（A错）。4-5个月后可减至5次（B错）。 6-7个月逐渐减少喂奶次数（C错）。13-18个月停止哺乳并予以辅食（E错）。